绵马贯众具有驱虫与抗肿瘤作用的有效成分主要是
A. 间苯三酚类化合物
B. 挥发油
C. 鞣质
D. 树脂
E. 生物碱

正确答案：A。间苯三酚类化合物

解析：本题考查的是绵马贯众的成分。绵马贯众具有驱虫与抗肿瘤作用的有效成分主要是间苯三酚类化合物（A对）。绵马贯众【成分】根茎含间苯三酚类化合物，有绵马酸类、黄绵马酸、白绵马素类、去甲绵马素类、绵马酚、绵马次酸、粗蕨素等。当归【成分】含挥发油（B错）及水溶性成分。五倍子【成分】含五倍子鞣质（C错），习称五倍子鞣酸，含量50%～70%，有的达78%。另含没食子酸2%～4%、白果酚、月桂酸、脂肪、树脂（D错）及蜡质等。川乌【成分】根含生物碱（E错）及乌头多糖。